参松养心胶囊除能清心安神外，还能
A. 活血化瘀，化痰通络
B. 益气养血，通脉止痛
C. 活血化瘀，行气止痛
D. 益气养阴，活血通络
E. 益气活血，通络止痛

正确答案：D。益气养阴，活血通络

解析：本题考查的是参松养心胶囊的功能。参松养心胶囊除能清心安神外，还能益气养阴，活血通络（D对）。益气养阴，活血通络为参松养心胶囊的功能。参松养心胶囊：【功能】益气养阴，活血通络，清心安神。华佗再造丸：【功能】活血化瘀，化痰通络（A错），行气止痛。心可舒胶囊：【功能】活血化瘀，行气止痛（C错）。通心络胶囊：【功能】益气活血，通络止痛（E错）。功能为益气养血，通脉止痛（B错）的中成药，2022年考试指南未明确说明。